坐骨神经在下行中经过
A. 髂后上棘与坐骨结节连线的上中1/3的交点处
B. 坐骨结节与股骨大转子连线的中点处
C. 股骨内、外上髁的连线中点处
D. 髂前上棘与坐骨结节连线的中点处
E. 髂后上棘与髂前上棘连线的中点处

正确答案：B。坐骨结节与股骨大转子连线的中点处

解析：坐骨神经从骶丛发出后，经梨状肌下孔出盆腔至臀大肌深面，在坐骨结节与大转子连线的中点（B对）深面下行到达股后区。